丙型肝炎病毒（HCV）的主要传播途径为
A. 消化道传播
B. 输血传播
C. 虫媒传播
D. 呼吸道传播
E. 直接接触传播

正确答案：B。输血传播

解析：（P388）“3.丙型肝炎病毒（HCV）为RNA病毒，主要经血液传播（B对），性接触和母婴途径有较高的感染风险，潜伏期1~6个月，易变异，是慢性化最高的肝炎病毒”。